边缘性颌骨骨髓炎最多见的感染途径是
A. 牙源性
B. 血源性
C. 损伤性
D. 腺源性
E. 医源性

正确答案：A。牙源性

解析：本题考查边缘性颌骨骨髓炎最多见的感染途径。化脓性颌骨骨髓炎包括中央性颌骨骨髓炎和边缘性颌骨骨髓炎，感染途径主要有：①牙源性感染，临床上最多见，占化脓性颌骨骨髓炎的90%左右（A对）；②损伤性感染，可引起损伤性颌骨骨髓炎（C错）；③血源性感染，感染经血行扩散至颌骨发生的骨髓炎，易在颌面部或全身其他部位出现化脓性病变或菌血症时发生（B错）。腺源性感染常见于口腔、上呼吸道感染继发淋巴结感染，引起筋膜间隙的蜂窝织炎（D错）。医源性感染常见于局麻、手术、穿刺等操作未严格遵守无菌技术造成继发性感染（E错）。